依据《中华人民共和国药品管理法》，以下属于药品范围的有
A. 中药材
B. 中药饮片
C. 血清、疫苗
D. 保健品
E. 体外化学诊断试剂

正确答案：A、B、C、E。中药材；中药饮片；血清、疫苗；体外化学诊断试剂

解析：本题考查药品。属于药品范围的有中药材（A对）、中药饮片（B对）、血清、疫苗（C对）、体外化学诊断试剂（E对）。药品是指用于预防、治疗、诊断人的疾病，有目的地调节人的生理机能并规定有适应症或者功能主治、用法和用量的物质，包括中药材、中药饮片、中成药、化学原料药及其制剂、抗生素、生化药品、放射性药品、血清、疫苗、血液制品和诊断药品等。